化学药品说明书格式中应在【药品名称】项下填写
A. 通用名
B. 拉丁文名
C. 商品名
D. 英文名
E. 汉语拼音

正确答案：A、C、D、E。通用名；商品名；英文名；汉语拼音

解析：本题考查说明书。化学药品说明书格式中应在【药品名称】项下按顺序列出：（1）通用名称（A对）：中国药典收载的品种，其通用名称应当与药典一致；或者与国家批准的该品种药品标准中的药品名称一致；药典未收载的品种，其名称应当符合药品通用名称命名原则。（2）商品名称（C对）：未批准使用商品名称的药品不列该项。（3）英文名称（D对）：无英文名称的药品不列该项。（4）汉语拼音（E对）。